医学人道观的基本内容不包括
A. 尊重患者的平等医疗保健权
B. 消除或减轻影响患者健康的危险因素
C. 对患者尽量使用高新技术
D. 尊重患者的人格
E. 尊重患者的生命

正确答案：C。对患者尽量使用高新技术

解析：根据医学人本论概念，尊重患者的平等医疗保健权（A对）体现的是人本论中尊重患者权利。消除或减轻影响患者健康的危险因素（B对）和尊重患者的生命（E对）体现了人本论中将人的生命健康放在第一位的内在要求。尊重患者的人格（D对）体现人本论中尊重患者人格内在要求。对患者尽量使用高新技术（C错，为本题正确答案）不属于人本论范畴。